男，50岁。突起呼吸困难，咳粉红色泡沫痰。血压190/100mmHg。诊断为急性左心衰。该患者的最佳治疗是
A. 西地兰
B. 氨茶碱
C. 硝普钠
D. 多巴酚丁胺
E. 硝酸甘油

正确答案：C。硝普钠

解析：患者中年男性，突起呼吸困难，咳粉红色泡沫痰，血压突然和明显升高（正常值＜140/90mmHg），考虑诊断为高血压急症伴急性左心衰。该患者的最佳治疗是静注硝普钠（C对）。硝普钠为动、静脉血管扩张剂，可迅速降低血压，常作为高血压急症的首选用药。西地兰（毛花苷C）（A错）最适合用于有快速心室率的心房颤动并心室扩大伴左心室收缩功能不全者；氨茶碱（B错）可解除支气管痉挛，也能增强心肌收缩、扩张血管；多巴酚丁胺（D错）可降低外周阻力，增加心肌收缩力和心输出量，三者都主要用于急性左心衰竭的治疗，但对高血压急症效果不大。硝酸甘油（P258）（E错）可用于高血压急症伴急性心力衰竭的治疗，但因其降低动脉压作用不及硝普钠，也并非本题最佳治疗药物。